当副交感神经兴奋时
A. 心跳加强，血压下降
B. 支气管平滑肌收缩
C. 瞳孔开大
D. 胃肠蠕动减弱
E. 以上都不是

正确答案：B。支气管平滑肌收缩

解析：副交感神经兴奋时，出现心跳减慢、血压下降、支气管收缩（B对）、瞳孔缩小、消化活动增强等现象。